单颌全口义齿修复要点为
A. 天然牙调（牙合）
B. 人工牙排列与咬合关系
C. 增加义齿基托强度
D. 控制咬合力
E. 以上说法均正确

正确答案：E。以上说法均正确

解析：单颌全口义齿修复要点：①天然牙调（牙合）；②人工牙排列与咬合关系：③控制咬合力；④增加义齿基托强度。掌握“单颌全口义齿”知识点。